下列有关机体失代偿的表现除外的是
A. 意识淡漠
B. 脉搏细速
C. 脉压为零
D. 四肢湿冷
E. 尿少

正确答案：C。脉压为零

解析：随着休克的发展，患者常常意识淡漠，脉搏细速，脉压变小，四肢湿冷，尿少等症状，一旦出现收缩压下降，表明血容量丢失达到20%以上，是机体失代偿的表现。掌握“口腔颌面部创伤急救”知识点。